不具有磺酰胺基结构，更容易引起耳毒性的药物是
A. 布美他尼
B. 呋塞米
C. 依他尼酸
D. 托拉塞米
E. 螺内酯

正确答案：C。依他尼酸

解析：本题考查依他尼酸。不具有磺酰胺基结构，更容易引起耳毒性的药物是依他尼酸（C对）。依他尼酸用于水肿性疾病，包括充血性心力衰竭、肝硬化、肾脏疾病（肾炎、肾病及各种原因所致的急、慢性肾功能衰竭），尤其是应用其他利尿药效果不佳时，应用本类药物仍可能有效，与其他药物合用治疗急性肺水肿和急性脑水肿等，是一个非磺酰胺衍生物的袢利尿剂，与其他袢利尿剂相比耳毒性更大。呋塞米（B错）、布美他尼（A错）和托拉塞米（D错）的结构中都含有磺酰胺（脲）基团，且耳毒性均比依他尼酸小。螺内酯（E错）用于水肿性疾病、高血压、原发性醛固酮增多症、低钾血症的预防，为醛固酮的竞争性抑制剂。